能活血止痛，消肿生肌的药是
A. 姜黄
B. 丹参
C. 没药
D. 自然铜
E. 益母草

正确答案：C。没药

解析：本题考查的是没药的功效。能活血止痛，消肿生肌的药是没药（C对）。没药：【功效】活血止痛，消肿生肌。姜黄（A错）：【功效】破血行气，通经止痛。丹参（B错）：【功效】活血祛瘀，通经止痛，清心除烦，凉血消痈。自然铜（D错）：【功效】散瘀止痛，接骨疗伤。益母草（E错）：【功效】活血祛瘀，利尿消肿，清热解毒。